不属于根分叉区病变的治疗目标的是
A. 清除根分叉病变区内牙根面上的牙石
B. 通过手术等方法形成有利于患者进行菌斑控制的局部外形
C. 早期病变尽量争取一定的牙周组织再生
D. 消炎止痛，防止感染扩散，引流脓液
E. 通过一些手段清除根分叉区的菌斑，并控制炎症

正确答案：D。消炎止痛，防止感染扩散，引流脓液

解析：本题考查根分叉病变。不属于根分叉区病变的治疗目标的是消炎止痛，防止感染扩散，引流脓液（D错，为本题正确答案）。根分叉区病变的治疗目标有三点：①清除根分叉病变区内牙根面上的牙石（A对）、菌斑，控制炎症（E对）；②通过手术等方法，形成一个有利于患者自我控制菌斑并长期保持疗效的局部解剖外形（B对），阻止病变加重；③对早期病变，争取有一定程度的牙周组织再生（C对），这方面尚有一定难度。